男孩，1岁半。1天前流清涕，今晨低热，2小时后体温升高达39.7℃，突发全身强直阵挛性惊厥，面色发绀，意识丧失持续1分钟自行停止。数分钟后患儿完全清醒，精神良好。查体：颈无抵抗，双侧巴氏征（＋）。血常规：Hb116g/L，WBC7.5×10⁹/L，N0.70，Plt150×10⁹/L。诊断是
A. 复杂型热性惊厥
B. 癫痫
C. 单纯型热性惊厥
D. 化脓性脑膜炎
E. 病毒性脑炎

正确答案：C。单纯型热性惊厥

解析：1岁半小儿（FS高发年龄），1天前流清涕（感染诱因），现病史有发热，突发全身强直阵挛性惊厥（发热期突然出现的惊厥）。持续1分钟自行停止（＜15分钟），数分钟后患儿完全清醒（热性惊厥多于惊厥后神志很快恢复）。查体：颈无强直（脑膜炎常见体征），双侧巴氏征阳性（2岁内小儿巴氏征阳性可属正常）；查血常规未见异常（初步排除感染性脑膜炎）（DE错）。据患者年龄、临床表现和实验室检查等，最可能的诊断为单纯型热性惊厥（C对）。复杂型热性惊厥（A错）发作时间长＞15分钟，伴局灶性发作和（或）24小时内或同一热性病程中反复发作。